可导致内斜视
A. 视神经
B. 动眼神经
C. 外展神经
D. 滑车神经
E. 三叉神经

正确答案：C。外展神经

解析：外展神经（C对）支配的眼外肌为外直肌，外展神经损伤会导致外直肌瘫痪，眼球向外活动受限，出现内斜视。视神经（A错）损伤会导致视觉传入障碍，出现视力、视野下降。动眼神经（B错）损伤会导致上睑提肌、上直肌、内直肌、下直肌、下斜肌瘫痪，出现上睑下垂、眼球外下斜视。滑车神经（D错）损伤会导致上斜肌瘫痪，出现眼球向外下活动受限。三叉神经（E错）损伤会导致头面部、口鼻腔感觉传入障碍、咀嚼肌瘫痪。